下列哪项不是“煤烟型烟雾事件”的特点
A. 大气污染物主要是煤炭的燃烧产物
B. 有气温高，气压低，无风，晴朗等气象条件
C. 多发生在寒冷季节
D. 易发生在河谷盆地
E. 受害者呼吸道刺激症状出现最早

正确答案：B。有气温高，气压低，无风，晴朗等气象条件

解析：本题考查煤烟型烟雾事件的特点。煤烟型烟雾事件的污染来源是煤和石油制品燃烧（A对）；主要污染物是颗粒物、SO₂、硫酸雾；发生季节多在冬季（C对）；发生时间多在早晨；气象条件多为气温低、气压高、风速很低、湿度高、有雾（B错，为本题正确答案）；逆温类型是辐射逆温；地理条件为河谷或盆地易发生（D对）；症状多为咳嗽、喉痛、胸痛、呼吸困难（E对），伴有恶心、呕吐、发绀等，死亡原因多为支气管炎、肺炎和心脏病；易感人群多为老年人、婴幼儿以及心、肺疾病患者。